某女，55岁。头痛10年，久治不愈。痛如针刺，固定不移，舌紫，脉细涩。治宜选用的方剂是
A. 补阳还五汤
B. 川芎茶调散
C. 通窍活血汤
D. 羚羊钩藤汤
E. 龙胆泻肝汤

正确答案：C。通窍活血汤

解析：本题考查的是头痛的辨证论治。头痛10年，久治不愈。痛如针刺，固定不移，舌紫，脉细涩。治宜选用的方剂是通窍活血汤（C对）。头痛是临床常见的自觉症状，可单独出现，亦见于多种疾病的过程中。本节所讨论的头痛，是指因外感六淫或疠气、内伤杂病而引起的，以头痛为主要表现的疾病。西医学中的血管性头痛、神经性头痛、三叉神经痛、外伤后头痛、五官科疾病的头痛以及部分颅内疾病引起的头痛等，可参考此内容辨证论治。（一）风寒头痛：【症状】头痛时作，痛连项背，常有拘急收紧感，伴恶风畏寒，受风尤剧，口不渴。舌苔薄白，脉浮紧。【方剂应用】基础方剂为川芎茶调散（B错）（川芎、荆芥、薄荷、羌活、细辛、白芷、甘草、防风）加减。（二）风热头痛：【症状】头痛而胀，甚则头痛如裂，发热或恶风，口渴欲饮，面红目赤，或便秘溲黄。舌尖红，苔黄，脉浮数。【方剂应用】基础方剂为芎芷石膏汤（川芎、白芷、石膏、菊花、藁本、羌活）加减。（三）肝阳头痛：【症状】头昏胀痛，两侧为重，心烦易怒，夜寐不宁，口苦面红，或兼胁痛。舌红苔黄，脉弦数。【方剂应用】基础方剂为天麻钩藤饮（天麻、钩藤、生石决明、川牛膝、桑寄生、杜仲、栀子、黄芩、益母草、朱茯神、夜交藤）加减。（四）血虚头痛：【症状】头痛隐隐，时时昏晕，心悸失眠，面色少华，神疲乏力，遇劳加重。舌质淡，苔薄白，脉细弱。【方剂应用】基础方剂为加味四物汤（白芍、当归、熟地黄、川芎、蔓荆子、菊花）加减。（五）瘀血头痛：【症状】头痛经久不愈，痛处固定不移，痛如锥刺，或有头部外伤史。舌紫暗，或有瘀斑，瘀点，苔薄白，脉细或细涩。【方剂应用】基础方剂为通窍活血汤（赤芍、川芎、桃仁、红花、麝香、老葱、鲜姜、枣、酒）加减。补阳还五汤（A错）为中风气虚血瘀证的方剂应用。中风气虚血瘀证：【症状】肢体偏枯不用，肢软无力，面色萎黄。舌质淡紫或有瘀斑，苔薄白，脉细涩或细弱。【方剂应用】基础方剂为补阳还五汤（黄芪、当归、川芎、桃仁、红花、赤芍、地龙）加减。龙胆泻肝汤（E错）为不寐肝火扰心证的方剂应用。不寐肝火扰心证：【症状】不寐多梦，甚则彻夜不眠，急躁易怒，伴头晕头胀，目赤耳鸣，口干而苦，不思饮食，便秘溲赤。舌红苔黄，脉弦而数。【方剂应用】基础方剂为龙胆泻肝汤（龙胆、泽泻、木通、车前子、当归、柴胡、生地黄、黄芩、栀子、生甘草）加减。方剂应用为羚角钩藤汤（D错）的病证，2022年考试指南未明确说明。